用反相高效液相色谱法测定盐酸肾上腺素注射液的含量，所采用的流动相系统是
A. 甲醇-水
B. 乙腈-水
C. 庚烷磺酸钠溶液-甲醇
D. 磷酸二氢钾溶液-甲醇
E. 冰醋酸-甲醇-水

正确答案：C。庚烷磺酸钠溶液-甲醇